不属于高血压行为危险因素的是
A. 紧张刺激
B. 缺少锻炼
C. 从医行为不良
D. 遗传因素
E. 吸烟

正确答案：D。遗传因素